评价学校健康教育对提高学生知识、信念和行为改变的情况时最常用的方法是
A. 问卷调查
B. 行为观察
C. 自我评估
D. 访谈
E. 小组讨论

正确答案：A。问卷调查